反映外源性化学物质对机体毒性作用本质的指标，有助于取得中毒机制的线索的是
A. 食物利用率
B. 脏器系数
C. 病理学检查
D. 一般性指标
E. 特异性指标

正确答案：E。特异性指标